关于颅底骨折，下列哪项是错误的
A. 形态多为线性骨折
B. 根据部位可分为三型
C. 若伤及颈动脉，形成海绵窦瘘
D. 大多表现为中枢性面瘫
E. X线片仅显示为30%～50%的骨折线

正确答案：D。大多表现为中枢性面瘫

解析：颅底骨折大多数为线形骨折（A对），按骨折的部位可分为颅前窝骨折、颅中窝骨折和颅后窝骨折三种类型（B对），主要表现为耳、鼻出血或脑脊液漏，脑神经损伤及皮下或黏膜下瘀血斑，一般不会出现出现中枢性面瘫（D错，为本题正确答案）。颅中窝骨折若伤及颈动脉，可形成颈内动脉-海绵窦瘘（C对）。头颅X线片对颅底骨折的诊断价值有限，仅可显示显示30%～50%的骨折线（七版黄家驷外科学P834）（E对）。